关于药物β-环糊精包合物作用的说法，错误的是
A. 提高药物的稳定性
B. 减少药物的刺激性
C. 增加药物的溶解度
D. 增加药物的靶向性
E. 使液体药物粉末化

正确答案：D。增加药物的靶向性

解析：本题考查的是环糊精包合物的作用。关于药物β-环糊精包合物作用的说法，错误的是增加药物的靶向性（D错，为本题正确答案）。环糊精包合技术系指将药物分子包藏于环糊精分子空穴结构内形成环糊精包合物的技术。环糊精包合物的作用：①提高药物的稳定性（A对）。②增加药物的溶解度（C对）。③减少药物的刺激性（B对），掩盖不良臭味。④调节药物的释放速度。⑤使液体药物粉末化（E对）而便于制剂。增加药物的靶向性为靶向制剂的特点。